女，20岁，近一年来时有右下腹疼痛伴膀胱刺激症状。体检：腹软右下腹深压痛，右腰部轻叩痛。尿常规红细胞++/HP，白细胞+/HP。肾图检查：右侧呈梗阻型曲线，应考虑为
A. 慢性膀胱炎
B. 急性阑尾炎
C. 慢性附件炎
D. 急性肾盂肾炎
E. 右输尿管下段结石

正确答案：E。右输尿管下段结石

解析：青年女性患者，有右下腹疼痛，尿常规红细胞++/HP（提示有血尿），肾图示右侧呈梗阻型曲线（提示有上尿路梗阻），考虑患者有上尿路结石。患者有膀胱刺激症状，右下腹深压痛，提示结石位于输尿管下段近膀胱壁。结合患者病史、临床表现、体检及相关检查，应考虑为右输尿管下段结石（E对）。慢性膀胱炎（A错）、慢性附件炎（C错）患者一般不会出现尿路梗阻症状。急性阑尾炎（B错）典型表现为转移性右下腹痛，无血尿。急性肾盂肾炎（D错）典型表现有发热、腰痛、膀胱刺激症状，一般也不会出现尿路梗阻症状。